确证的人类致癌物必须有
A. 人类流行病学及动物致癌实验方面充分的证据
B. 经动物实验及流行病学调查研究，并有一定的线索
C. 充分流行病学调查研究的结果
D. 已建立了动物模型

正确答案：A。人类流行病学及动物致癌实验方面充分的证据

解析：本题考查人类致癌物。确证的人类致癌物必须有人类流行病学及动物致癌实验方面充分的证据（A对BCD错）。